复方益母草膏不具有的功能是
A. 调经
B. 疏肝
C. 养血调经
D. 化瘀
E. 生新

正确答案：B。疏肝

解析：本题考查的是复方益母草膏的功能。复方益母草膏不具有的功能是疏肝（B错，为本题正确答案）。复方益母草膏【功能】调经养血（AC对），化瘀（D对）生新（E对）。